邻近口腔处的甲状舌管囊肿的衬里多为
A. 复层椭圆上皮
B. 假复层柱状上皮
C. 单层柱状上皮
D. 纤毛柱状上皮
E. 复层鳞状上皮

正确答案：E。复层鳞状上皮

解析：邻近口腔处的甲状舌管囊肿衬里多为复层鳞状上皮，而位置靠下方者多为纤毛柱状上皮衬里。纤维性囊壁内偶见甲状腺或黏液腺组织。掌握“甲状舌管囊肿”知识点。